流行性脑脊髓膜炎典型表现是
A. 粘液脓血便
B. 米泔水样便
C. 酒醉貌
D. 皮肤、巩膜黄染
E. 皮肤粘膜出血点

正确答案：E。皮肤粘膜出血点

解析：脑膜炎球菌释放的内毒素是流行性脑脊髓膜炎致病的重要因素，内毒素引起全身的施瓦茨曼反应，激活补体，血清炎症介质明显增加，导致血管内皮损害，血管壁炎症、坏死和血栓形成，血管周围出血，表现为皮肤粘膜出血点（E对），为流行性脑脊髓膜炎的典型表现。粘液脓血便（A错）为细菌性痢疾的典型大便性状改变；米泔水样便（B错）为霍乱的典型大便性状改变；酒醉面容（C错）为流行性出血热发热期毛细血管损伤征的典型表现，表现为颜面、颈部、上胸部呈弥漫性潮红，即"三红"征，似酒醉貌；皮肤、巩膜黄染（D错）为黄疸的典型表现。